急性细菌性扁桃体炎患者常表现为
A. 血红蛋白减少
B. 嗜酸性粒细胞增多
C. 中性粒细胞增多
D. 红细胞增多
E. 血小板增多

正确答案：C。中性粒细胞增多

解析：本题考查血常规检查。急性细菌性扁桃体炎患者常表现为中性粒细胞增多（C对）。急性感染，如细菌、某些病毒、真菌、螺旋体等感染时白细胞（中性粒细胞）增加。血红蛋白减少（A错）常见于缺铁性贫血。嗜酸性粒细胞增多（B错）见于支气管哮喘、荨麻疹、湿疹、慢性粒细胞白血病、嗜酸性粒细胞白血病、猩红热、风湿性疾病等。红细胞增多（D错）见于慢性肺心病、肺气肿、高原病和肿瘤（肾癌、肾上腺肿瘤）。血小板增多（E错）见于慢性粒细胞白血病、真性红细胞增多症、急性感染、急性溶血等。